某地区有10万人口，1960年总死亡人数1000名，已发现的结核病患者有300名，男性200名，女性有100名，1960年有60名死于结核病，其中50名为男性，结核病的比例死亡率（病因构成比）为
A. 0.2
B. 0.3
C. 0.06
D. 0.03
E. 所给资料不能计算

正确答案：C。0.06

解析：本题考查比例死亡率的计算。比例死亡率＝某地区某时间患某病死亡的人数/某地区某时间总死亡人数＝60/1000×100%＝6%（C对ABDE错）。